治疗铅、汞等中毒时，对青霉胺的用法用量描述正确的有
A. 每日1g，分4次服
B. 每日2g，分4次服
C. 15日为一疗程
D. 5～7日为一疗程
E. 停药2日后开始第二疗程

正确答案：A、D、E。每日1g，分4次服；5～7日为一疗程；停药2日后开始第二疗程

解析：本题考查重金属中毒解救。青霉胺可用于驱铅治疗和驱汞治疗。用法用量为：一日1g，分4次服用（A对B错），5～7天为一疗程（D对C错），停药2日后开始第二疗程（E对），一般1～3个疗程。